胸腔穿刺的指征不正确的是
A. 检查胸腔积液的性质
B. 穿刺胸膜腔给药
C. 抽液减压
D. 疑为恶性胸腔积液者
E. 常在CT下引导穿刺

正确答案：E。常在CT下引导穿刺

解析：当患者出现胸腔积液时，要根据积液性质制定相应的治疗方式，在不明积液性质时要进行胸腔穿刺来明确（A对），除了心衰、感染等引起的良性积液外，恶性肿瘤引起的胸腔积液也要通过胸腔穿刺抽液化验明确积液性质（D对）。当出现感染性脓胸，如化脓性或结核性，为了使药物更好的作用于病患部位，提高有效药物浓度，可直接胸膜腔穿刺给敏感抗生素等药物（B对）。结核性胸膜炎时，胸水蛋白含量高，以引起胸膜粘连，故应尽快抽尽胸腔积液，且抽液后有助于被压迫的肺复张（C对）。胸腔穿刺一般可不借助外界辅助，可直接穿刺或者B超定位下穿刺，而不是在CT引导下穿刺，CT不仅对人体有辐射作用，而且CT为断层扫描图像也不适合引导穿刺（E错，为本题正确答案）。